长期大量吸入异丙肾上腺素气雾，造成的不良反应是
A. 鹅口疮与声音嘶哑
B. 咽喉和支气管刺激
C. 心悸和心动过速
D. 口干、口苦及尿潴留
E. 发热、脱水和心律失常

正确答案：C。心悸和心动过速